丙氨酸氨基转移酶（ALT）活力与肝细胞受损程度的关系是
A. 呈正相关系
B. 呈负相关系
C. 不成比例
D. 关联性不大
E. 无关联性

正确答案：A。呈正相关系

解析：本题考查肝功能检查。丙氨酸氨基转移酶（ALT）活力与肝细胞受损程度的关系是呈正相关系（A对）。丙氨酸氨基转移酶是一组催化氨基酸与α-酮酸间氨基转移反应的酶类，旧称谷丙转氨酶（GPT），主要存在于肝、肾、心肌、骨骼肌、胰腺、脾、肺、红细胞等组织细胞中，同时也存在于正常体液如血浆、胆汁、脑脊液、唾液中。当富含ALT的组织细胞受损时，ALT从细胞释放增加，进入血液后导致ALT活力上升，其增高的程度与肝细胞被破坏的程度呈正比。